口腔天然菌群中占比例最大的链球菌属是
A. 血链球菌
B. 轻链球菌
C. 变形链球菌
D. 乳杆菌
E. 放线菌

正确答案：C。变形链球菌

解析：本题考查口腔天然菌群。口腔天然菌群中占比例最大的链球菌属是变形链球菌（C对）。变形链球菌为革兰氏染色阳性的球菌，为牙斑主要成分之一，与人类龋病密切相关。血链球菌（A错）、轻链球菌（B错）均是天然菌群，但不是比例最大的。乳杆菌（D错）属于乳杆菌属，不属于链球菌属。放线菌（E错）属于放线菌属，也不属于链球菌属。